患者，男，50岁。高血压病史15年，未坚持服药。2小时前因情绪激动突然意识不清，双侧瞳孔不等大。应首先考虑的是
A. 酒精中毒
B. 药物中毒
C. 高血压性脑出血
D. 脑血栓
E. 心功能不全

正确答案：C。高血压性脑出血

解析：高血压性脑出血患者既往有高血压动脉硬化病史，多突发意识障碍和偏瘫。本例患者为中年男性，有高血压病史，长期未坚持药物治疗，此次因情绪激动突发意识不清，查体可见双侧瞳孔不等大，提示有颅内病变，故诊断应首先考虑的是高血压性脑出血（C对）。酒精中毒（A错）患者常有大量饮酒史，主要表现为昏睡、瞳孔散大。药物中毒（B错）临床表现与中毒药物类型有关。脑血栓（D错）可引起缺血性脑卒中，主要表现为头痛、头晕等。心功能不全（E错）主要表现为心悸、呼吸困难，活动后症状常加剧，瞳孔一般无明显变化。